关于氢氧化钙类根管封闭剂的优点没有
A. 具有强碱性
B. 超强的X线阻射性能
C. 促进根尖周组织愈合
D. 诱导硬组织形成
E. 较好的抗菌效果

正确答案：B。超强的X线阻射性能

解析：氢氧化钙类主要优点是具有较好的抗菌效果，诱导硬组织形成，促进根尖周组织愈合。掌握“根管充填”知识点。